下列关于颌面骨结核的治疗的方法中，错误的是
A. 全身支持
B. 营养疗法
C. 抗结核治疗
D. 骨结核的抗结核药物治疗疗程一般需3个月以上
E. 对颌骨病变处于静止期而局部已有死骨形成者，应行死骨及病灶清除术

正确答案：D。骨结核的抗结核药物治疗疗程一般需3个月以上

解析：无论全身其他部位是否合并有结核病灶，均应进行全身支持、营养疗法和抗结核治疗。由于骨结核的抗结核药物治疗疗程一般需6～12个月以上，为减少耐药菌株出现，一般主张采用两种药物的联合用药方法。为了提高疗效、缩短药物疗程，对颌骨病变处于静止期而局部已有死骨形成者，应行死骨及病灶清除术。掌握“颌面部骨结核、放线菌病”知识点。